最常见的低度恶性卵巢性索间质肿瘤是
A. 颗粒细胞瘤
B. 卵泡膜细胞瘤
C. 颗粒-卵泡膜细胞瘤
D. 间质细胞瘤
E. 无性细胞瘤

正确答案：A。颗粒细胞瘤

解析：卵巢性索间质肿瘤起源于原始性腺中的性索和间质组织，分别在男性和女性衍化成各自不同类型的细胞，这些细胞可各自形成女性的颗粒细胞瘤（A）和卵泡膜细胞瘤（B），或男性的支持细胞瘤和间质细胞瘤（D），亦可混合构成颗粒-卵泡膜细胞瘤（C）或支持-间质细胞瘤。其中颗粒细胞瘤（A对）是伴有雌激素分泌的功能性肿瘤，属于低度恶性肿瘤。无性细胞瘤（P298）（E错）属于卵巢生殖细胞肿瘤，较为少见。